医患关系的实质是
A. 具有经济性质的商业关系
B. 具有契约性质的信托关系
C. 具有法律性质的契约关系
D. 具有市场性质的交换关系
E. 具有宗教性质的文化关系

正确答案：B。具有契约性质的信托关系

解析：医患关系是信托关系。医师和病人在医学知识上存在着信息不对称的现象。在诊疗中，基于对医师的信任，病人将健康托付给医师。医师则运用自己的专业知识和技能，尽最大的能力医治疾病，减少痛苦。信任在先，托付在后。医患关系是契约关系。由于现实环境的复杂性，仅靠建立在情感基础上的医患信任关系很难长久维持，还需要一种机制和制度化。于是，病人在医院挂号就医后，基于医患双方法律地位的平等性和医师对专业职责的认可与承诺——病人利益至上，双方形成了明确和既定的医患契约关系，因此医患关系的本质特征是具有契约性质的信托关系（B对）。